男，42岁。寒战、发热5天，右季肋部痛2天，疼痛于深呼吸及咳嗽时加重。查体：巩膜轻度黄染，肝肋下2cm，Murphy征阴性，肝区叩击痛阳性。胸部X线片：右侧膈肌抬高，肋脊角消失。肝脏B超：肝右叶可见6cm×5cm低回声区，边界欠清晰，中心有液性暗区。首先考虑的诊断是
A. 肺炎
B. 肝脓肿
C. 肝结核
D. 结核性胸膜炎
E. 肝癌

正确答案：B。肝脓肿

解析：中年患者，寒战、发热（感染症状），肝区叩击痛，肝肋下2cm（肝大），B超示肝右叶液性暗区（脓肿形成）。结合临床表现及相应检查，首先考虑的诊断是肝脓肿（B对）。肺炎（A错）不会出现巩膜轻度黄染（黄疸）及肝区积液。肝结核（C错）常为全身性结核病的一部分，应有结核病史。结核性胸膜炎（D错）一般同时有全身性的结核病表现，且不会造成肝区积液。肝癌（E错）很少表现出急性的高热寒战等症状，且B超检查不应有液性暗区。